单室模型单剂量静脉滴注给药，血药浓度公式为
A. C=K₀/KV*（1-e-kt）
B. C=C₀e-kt
C. Css=C₀*1/（1-e-kt）*e-kt
D. C=KaFK₀/V（Ka-K）*（e-kt-e-kat）
E. Css=K₀/KV

正确答案：A。C=K₀/KV*（1-e-kt）

解析：本题考查血药浓度公式。单室模型单剂量静脉滴注给药，血药浓度公式为C=K0/KV*（1-e-kt）（A对）。单室模型单剂量静脉滴注给药，稳态血药浓度公式为Css=K₀/KV（E错）。